阿司匹林药品质量标准收载的内容中，属于鉴别项的有
A. 本品为白色结晶或结晶性粉末；无臭或微带醋酸臭；遇湿气即缓缓水解
B. 本品在乙醇中易溶，在三氯甲烷或乙醚中溶解，在水或无水乙醚中微溶
C. 取本品约0.1g，加水10ml，煮沸，放冷。加三氧化铁试液1滴，即显紫堇色
D. 本品的红外光吸收图谱应与对照的图谱（光谱集5图）一致
E. 炽灼残渣不得过0.1%（通则0831）

正确答案：C、D。取本品约0.1g，加水10ml，煮沸，放冷。加三氧化铁试液1滴，即显紫堇色；本品的红外光吸收图谱应与对照的图谱（光谱集5图）一致

解析：本题考查阿司匹林药品质量标准。阿司匹林药品质量标准收载的内容中，属于鉴别项的有：取本品约0.1g，加水10ml，煮沸，放冷。加三氧化铁试液1滴，即显紫堇色（C对）；本品的红外光吸收图谱应与对照的图谱（光谱集5图）一致（D对）。阿司匹林分子中具有酯结构，加水煮沸水解后生成水杨酸，水杨酸可与三氯化铁生成紫堇色的配位化合物。本品的红外光吸收图谱应与对照的图谱（光谱集5图）一致为红外光谱鉴别法。本品为白色结晶或结晶性粉末；无臭或微带醋酸臭；遇湿气即缓缓水解（A错）、本品在乙醇中易溶，在三氯甲烷或乙醚中溶解，在水或无水乙醚中微溶（B错）为性状项下的内容。炽灼残渣不得过0.1%（通则0831）（E错）为检查项下的干燥失重中的内容。